下列哪项不是抽样调查的优点
A. 调查费用相对较少
B. 出结果速度快
C. 结果正确性高
D. 样本数相同时，比普查覆盖面大
E. 适宜于罕见病的研究

正确答案：E。适宜于罕见病的研究

解析：本题考查抽样调查的优点。抽样调查具有节省时间、人力和物力资源等优点，调查费用少（A对），出结果快（B对），同时由于调查范围小，调查工作易于做得细致，结果正确性高（C对）。样本数相同时，抽样调查比普查覆盖面大（D对）。由于罕见病的研究（E错，为本题正确答案）需要较大的样本量，因此不适合用抽样调查。